某地对中、小学生贫血患病情况进行调查，抽查小学生410名，有贫血患者120名；抽查中学生320名，有贫血患者58名。欲知中、小学生贫血患病率有无不同，可选用
A. t检验
B. 方差分析
C. 秩和检验
D. X²检验
E. 配对X²检验

正确答案：D。X²检验